胃肠癌病人可出现
A. 血酸性磷酸酶升高
B. 血碱性磷酸酶升高
C. 血CEA升高
D. 血AFP升高
E. 血VCA-IgA抗体升高

正确答案：C。血CEA升高

解析：血CEA（癌胚抗原）升高（C对）主要见于胰腺癌、胃癌、结肠癌、直肠癌、乳腺癌、肺癌等患者。血酸性磷酸酶升高（A错）见于前列腺癌。血碱性磷酸酶升高（B错）见于肝损伤、骨肿瘤和恶性肿瘤骨转移。血AFP升高（D错）主要见于肝癌、生殖腺胚胎肿瘤和病毒性肝炎、肝硬化等。血VCA-IgA抗体升高（E错）提示EB病毒感染，EB病毒感染与鼻咽癌发病关系密切。